主痛证、痰饮、疟疾的脉象是
A. 滑脉
B. 结脉
C. 弦脉
D. 紧脉
E. 涩脉

正确答案：C。弦脉

解析：肝主疏泄，调畅气机，以柔为贵。若情志不遂，肝气郁结，疏泄失常，气郁不利致经脉拘束则见弦脉。若疟邪侵人，伏于半表半里，少阳枢机不利亦可见弦脉。寒热诸邪、疼痛、痰饮等，均可使肝失条达，气机阻滞，阴阳不和，脉气因而紧张，故脉可强硬而弦，并随邪气性质不同而或为弦紧，或为弦数，或为弦滑等（C对）。滑脉多见于痰湿、食积和实热等病证（A错）。结脉多见于阴盛气结、寒痰血瘀，亦可见于气血虚衰等证（B错）。紧脉多见于实寒证、疼痛、食积等（D错）。涩脉多见于气滞、血瘀、痰食内停和精伤、血少（E错）。